面对威胁性的应激源，通过各种适当的心理和行为对策来消除或缓解个体的紧张状态，称之为
A. 激励
B. 解脱
C. 回避
D. 应对
E. 超脱

正确答案：D。应对

解析：应对是指个体面对应激源的威胁时，采取的各种行为和策略以适应环境的要求以缓解情绪的紧张。掌握“心理应激”知识点。